以温肾阳的方法而补脾阳的治法是
A. 滋水涵木法
B. 益火补土法
C. 培土生金法
D. 金水相生法
E. 抑木扶土法

正确答案：B。益火补土法

解析：肾阳虚不能温脾，以致脾阳不振，即脾肾阳虚证。益火补土是通过温肾阳以助脾阳。故脾肾阳虚证治疗宜采用益火补土法（B对）。滋水涵木（A错）是通过滋肾阴以养肝阴的治法，主要用于肾阴亏损而致肝阴不足，甚至肝阳上亢证。培土生金法（C错）治疗脾虚水泛、水湿停聚病证。金水相生法（D错）主要用于治疗肺阴亏虚，不能滋养肾阴，或肾阴亏虚，不能滋养肺阴的肺肾阴虚证。抑木扶土法（E错）是疏肝健脾或平肝和胃以治疗肝脾不和或肝气犯胃病证的方法。